孤束核发出的味觉纤维止于背侧丘脑的
A. 腹外侧核
B. 腹前核
C. 腹后内侧核
D. 腹后外侧核
E. 无

正确答案：C。腹后内侧核

解析：背侧丘脑中特异性中继核团包括腹前核、腹外侧核、腹后核。其中孤束核发出的味觉纤维止于背侧丘脑的腹后内侧核（C对）。腹外侧核（A错）、腹前核（B错）主要接受小脑齿状核、苍白球和黑质传入纤维，后投射至躯体运动中枢，调节躯体运动。腹后外侧核（D错）接受内侧丘系和脊髓丘系的纤维。